减轻固定桥桥体所受（牙合）力的方法中错误的是
A. 脱离（牙合）接触
B. 扩大（牙合）面舌外展隙
C. 加深（牙合）面颊舌沟
D. 增加（牙合）面副沟
E. 减少（牙合）面颊舌径

正确答案：A。脱离（牙合）接触

解析：（牙合）力是导致挠曲的主要原因。过大的（牙合）力，会损害基牙牙周组织健康，还会引起桥体挠曲变形，甚至损毁固定桥。在缺牙间隙长时，更应注意减轻（牙合）力，即采取减小（牙合）面颊舌径宽度、扩大（牙合）面外展隙和加深（牙合）面颊舌窝沟等措施。掌握“固定桥的设计”知识点。